糖尿病合并高血压的患者首选的降压药物为
A. 依那普利
B. 美托洛尔
C. 氢氯噻嗪
D. 特拉唑嗪
E. 氨氯地平

正确答案：A。依那普利

解析：依那普利（A对）属于ACEI类降压药，其可抑制交感-肾素-血管紧张素-醛固酮系统，扩张外周血管而降低血压；还可改善胰岛素抵抗、减少尿蛋白形成，因此特别适合于糖尿病合并高血压的患者。美托洛尔（B错）属于选择性β₁受体阻滞剂，能增加胰岛素抵抗，还可能掩盖和延长低血糖反应（P253）；氢氯噻嗪（C错）属于噻嗪类利尿剂，可使血脂、血糖、血尿酸升高，故两者都不适合用于糖尿病合并高血压的患者。特拉唑嗪（D错）为α₁受体阻滞剂，通过降低动脉血管阻力，增加静脉容量来降低血压，因其副作用较多，目前不主张单独使用（P255）。氨氯地平（P255）（E错）属于钙通道阻滞剂，对血脂、血糖等无明显影响，可用于糖尿病伴高血压患者，但一般不作为首选。